药物有升降浮沉的药性，治法亦有升降浮沉的因势利导，参合两者即为升降浮沉配伍。下列不属于升降浮沉配伍的是
A. 交通心肾
B. 升阳散火
C. 釜底抽薪
D. 固涩止汗
E. 辛甘化阳

正确答案：E。辛甘化阳

解析：本题考查的是中药配伍原则。药物有升降浮沉的药性，治法亦有升降浮沉的因势利导，参合两者即为升降浮沉配伍。下列不属于升降浮沉配伍的是辛甘化阳（E错，为本题正确答案）。中药升降浮沉配伍：药物有升降浮沉的性用不同，治法亦有升降浮沉的因势利导，两者参合而行之，则治法甚多，变化无穷。具体运用有升降肺气（宣降法、开降法）、升降脾胃、升降肠痹、升阳泻火、升阳散火（B对）、升降相因、升水降火（交通心肾（A对））、开上通下（腑病治脏、下病上取）、提壶揭盖（以升为降）、上病下取（脏病治腑）、轻可去实、逆流挽舟、釜底抽薪（C对）、行气降气、引火归原、介类潜阳（养阴潜阳、潜阳息风）、重镇摄纳（具体包括镇肝息风、镇心安神、重镇降胃、重镇纳气、固涩止遗、固涩止汗（D对）、涩肠止泻、固崩止带）等。五味配伍：药物具酸、苦、甘、辛、咸等味，利用不同味的药物配伍组方，功效不同。如辛味药与甘味药配伍，可起辛甘发散、辛甘扶阳和辛甘化阳的功效。